症见呃声沉缓有力，膈间及胃脘不舒，得热则减，遇寒则甚，口中和，食纳少，舌苔白，脉迟缓，证属
A. 胃火上逆
B. 胃阴不足
C. 气机郁滞
D. 胃中寒冷
E. 脾胃阳虚

正确答案：D。胃中寒冷

解析：呃声沉缓有力，诊断为呃逆。胃气上冲喉间，故呃声沉缓有力；寒邪阻遏，肺胃之气失降，则膈间及胃脘不舒；寒气遇热则易于流通，遇寒则益增邪势，所以得热则减，遇寒则甚；口中和，食纳少，舌苔白，脉迟缓均属胃中有寒之象。以上症状属于胃中寒冷证，治疗应该用丁香散温中散寒，降逆止呃（D对）。胃火上逆证之呃逆的主要临床表现为呃声洪亮有力，冲逆而出，口臭烦渴，多喜冷饮，脘腹满闷，大便秘结，小便短赤等（A错）。胃阴不足证之呃逆的临床表现为呃声短促而不得续，口干咽燥，烦躁不安，不思饮食，或食后饱胀，大便干结，舌质红，苔少而干，脉细数（B错）。气机郁滞证之呃逆的主要临床表现为呃逆连声，常因情志不畅而诱发或加重，胸胁满闷，脘腹胀满，嗳气纳减，肠鸣矢气等（C错）。脾胃阳虚证之呃逆的主要临床表现为呃声低长无力，气不得续，泛吐清水，脘腹不舒，喜温喜按，面色㿠白，手足不温，食少乏力，大便溏薄等（E错）。